引起身体左半身痛温觉消失，而后产生右半身痉挛性瘫痪的髓外肿瘤是位于脊髓的
A. 左侧半的外侧
B. 右侧半的外侧
C. 左侧半的后内侧
D. 右侧半的后内侧
E. 右侧与左侧前角之间

正确答案：B。右侧半的外侧

解析：左半身痛温觉消失，而后产生右半身痉挛性瘫痪是脊髓半横断的特征，即损伤了脊髓丘脑束，所以该髓外肿瘤是位于脊髓的右侧半的外侧（B对）。